患者，男，30岁。高热寒战2天，胸痛，伴咳嗽，痰中带血。听诊：右肺中部可闻及湿啰音。应首先考虑的是
A. 急性支气管炎
B. 肺炎
C. 肺结核
D. 肺癌
E. 支气管哮喘

正确答案：B。肺炎

解析：患者突然出现高热寒战2天，为急性起病，咳嗽伴胸痛，痰中带血，听诊右肺中部可闻及湿啰音，应首先考虑为大叶性肺炎（B对）。急性支气管炎（A错）通常起病较急，主要症状为咳嗽和咳痰，常发生于寒冷季节或气候突变时，可无明显的阳性体征，或在两肺闻及散在干、湿性啰音，部位不固定，咳嗽后可减少或消失。肺结核（C错）多有全身中毒症状，如午后低热、盗汗、疲乏无力、体重减轻、失眠、心悸等。痰中可找到结核分枝杆菌。肺癌（D错）常见于有吸烟史及年龄较大的患者，多无急性感染中毒症状，有时痰中带血丝。支气管哮喘（E错）常有家庭或个人过敏病史，临床以听诊支气管哮鸣音为主要表现。